产生IL-2的细胞是
A. MΦ
B. T细胞
C. B细胞
D. NK细胞
E. 中性粒细胞

正确答案：B。T细胞